衣原体在细胞内的繁殖型是
A. 始体
B. 原体
C. 内基小体
D. 革兰阳性圆形体
E. 革兰阴性圆形体

正确答案：A。始体

解析：始体（又称网状体），无细胞壁，大而疏松，由原体在细胞内空泡中发育而成，不具感染性，为繁殖体形式，以二分裂繁殖，产生新的衣原体。掌握“衣原体”知识点。